牙周炎的病因中应首先考虑何种因素以指导治疗
A. 遗传因素
B. 内分泌因素
C. 免疫学因素
D. 菌斑因素
E. 营养因素

正确答案：D。菌斑因素

解析：本题考查牙周炎的病因及指导治疗。因为菌斑是牙周病的始动因子，去除菌斑能有效控制牙周病，所以菌斑因素（D对）是牙周炎病因中首先考虑的因素。菌斑控制应贯穿在牙周治疗过程的始终，而且在治疗后也要终身实施，才能保证牙周治疗的顺利进行并保持长期的疗效。遗传因素（A错）是由基因决定的不易改变。内分泌因素（B错）一般在特定年龄如青春期、特定性别如妊娠期妇女引起青少年牙龈炎或妊娠期龈炎，在控制菌斑的前提青春期过后、妊娠结束牙龈炎症会消退，所以由内分泌引起的牙龈炎不需首先考虑内分泌因素，应先考虑菌斑因素。免疫学因素（C错）不是引起牙周炎的致病因素，不需要考虑。营养因素（E错）有时与牙周炎有关，但是增加营养不去除菌斑的情况牙周炎不会治愈，营养因素不是牙周炎病因中首先考虑的因素。